以下关于乙型肝炎人群易感性的描述错误的是
A. 人群对HBV普遍易感
B. HBV感染后抗-HBs阳转者可在一定时期内维持免疫力
C. HBV各亚型间无交叉免疫
D. HBV感染具有明显的家族聚集现象
E. 接种乙肝疫苗是降低人群HBV易感性的有效措施

正确答案：C。HBV各亚型间无交叉免疫